利用息止颌位确定垂直距离的方法是
A. 测量息止颌位时鼻底至颏底的距离，即为垂直距离
B. 测量息止颌位时鼻底至颏底的距离减去2～3mm，即为垂直距离
C. 测量息止颌位时口角至颏底的距离即为垂直距离
D. 测量息止颌位时口角至颏底的距离减去2～3mm，即为垂直距离
E. 以上方法都不对

正确答案：B。测量息止颌位时鼻底至颏底的距离减去2～3mm，即为垂直距离

解析：本题考查确定垂直距离的方法-息止颌位法。利用息止颌位确定垂直距离时，要测量息止颌位时鼻底至颏底的距离减去2～3mm（即息止牙合间隙），此时为正中（牙合）时的垂直距离（B对）。在自然牙列存在时，当口腔不咀嚼、不吞咽、不说话时，下颌处于休息的静止状态，上下牙列自然分开，无（牙合）接触，叫做息止颌位，此时上下牙列间存在的间隙称息止（牙合）间隙，一般为2～3mm。垂直距离为自然牙列呈正中（牙合）时，鼻底至颏底的距离，也就是面下1/3的距离。